决定血浆PH（值）最重要的缓冲对是
A. KHCO₃/H₂CO₃
B. NaHCO₃/H₂CO₃
C. K₂HPO₄/KH₂PO₄
D. Na₂HPO₄/NaH₂PO₄
E. 蛋白质钠盐/蛋白质

正确答案：B。NaHCO₃/H₂CO₃

解析：血浆内的缓冲物质主要包括NaHCO₃/H₂CO₃、蛋白质钠盐/蛋白质（E错）和Na₂HPO4/NaH₂PO4（D错）三个缓冲对，其中最重要的是NaHCO₃/H₂CO₃（B对）。此外，红细胞内还有血红蛋白钾盐/血红蛋白、氧合血红蛋白钾盐/氧合血红蛋白、K2HPO4/KH₂PO4（C错）、KHCO₃/H₂CO₃（A错）。